把缓控释片嚼碎或研碎服用属于
A. 剂型差错
B. 重复用药
C. 速率差错
D. 配制差错
E. 用法差错

正确答案：E。用法差错

解析：本题考查用药错误。把缓控释片嚼碎或研碎服用属于用法差错（E对）。肠溶片（胶囊）、缓控释片（胶囊）需吞服，不可嚼碎或研碎服用。剂型差错（A错）、配置差错（D错）属于调剂错误。重复用药（B错）属于给药错误。速率差错（C错）属于处方错误。